灭鼠药磷化锌、磷化铝、磷化钙中毒，禁用
A. 氨茶碱
B. 阿扑吗啡
C. 阿托品
D. 乙酰半胱氨酸
E. 谷胱甘肽

正确答案：B。阿扑吗啡

解析：本题考查灭鼠药磷化锌、磷化铝、磷化钙中毒解救。灭鼠药磷化锌、磷化铝、磷化钙中毒用1%硫酸铜溶液催吐，禁用阿扑吗啡（B对）。磷化锌中毒的抢救治疗包括催吐、洗胃、导泻、对症和支
持疗法。口服中毒者，立即用1%硫酸铜溶液催吐。禁用阿扑吗啡。然后再用0.5%硫酸铜溶液1: 5000高锰酸钾溶液洗胃，直至洗胃液无蒜味为止。洗胃后口服硫酸钠（忌用硫酸镁）30g导泻。禁用油类泻剂，也不宜用蛋清、牛奶、动植物油类，因磷能溶解于脂肪中，可促进吸收而加重中毒。